某种生物摄取环境中的某些物质或化学元素后，在生物体内的某个部位或器官逐步浓缩起来，使其浓度大大超过环境中原有的浓度，称为
A. 生物放大作用
B. 生物蓄积作用
C. 生物浓缩作用
D. 生物相互作用
E. 生物降解作用

正确答案：C。生物浓缩作用

解析：本题考查生物浓缩作用。某种生物摄取环境中的某些物质或化学元素后，在生物体内的某个部位或器官逐步浓缩起来，使其浓度大大超过环境中原有的浓度，称为生物浓缩作用（C对ABDE错）。